某男性，建筑工人。夏季在某工地施工，突然感到头痛、头晕、全身无力来院就诊。经检查体温正常，并见其四肢肌肉痉挛。此工人可能患哪种疾病
A. 热射病
B. 休克
C. 热痉挛
D. 中暑
E. 日射病

正确答案：C。热痉挛